苯二氮䓬类药物中毒，选用的解毒剂是
A. 二巯丁二钠
B. 亚甲蓝
C. 氯解磷定
D. 氟马西尼
E. 盐酸纳洛酮

正确答案：D。氟马西尼

解析：本题考查苯二氮䓬类药物中毒解救。苯二氮䓬类药物中毒，选用的解毒剂是氟马西尼（D对）。氟马西尼是特异性苯二氮䓬受体阻断剂，能快速逆转昏迷，首次静脉注射剂量为0.3mg。二巯丁二钠（A错）用于锑、铅、汞、砷的中毒，并预防镉、钴、镍的中毒。亚甲蓝（B错）是氰化物中毒的解救药。氯解磷定（C错）用于有机磷中毒的解救。盐酸纳洛酮（E错）用于阿片类药物中毒的解救。